结构类型为二氢黄酮类的化合物是
A. 杨梅素
B. 杜鹃素
C. 汉黄芩素
D. 大豆素
E. 槲皮素

正确答案：B。杜鹃素

解析：本题考查含异黄酮类化合物的主要成分。葛根含异黄酮类化合物，主要成分有大豆素（D对）、大豆苷等。从满山红叶中已分离出杜鹃素、8-去甲基杜鹃素、山柰酚、槲皮素、杨梅素（A错）、金丝桃苷、异金丝桃苷以及莨菪亭、伞形酮、木毒素等。显色反应1.还原试验，杜鹃素（B错）可溶于甲醇、乙醚和稀碱液，难溶于水。与盐酸-镁粉反应呈粉红色，加热后变为玫瑰红色，与FeCl₃，反应呈草绿色。黄芩中的主要成分及其化学结构从黄芩中分离出来的黄酮类化合物有黄芩苷（含4.0%～5.2%）、黄芩素、汉黄芩苷、汉黄芩素（C错）等。槐米含有芦丁、槲皮素（E错）、皂苷、白桦脂醇、槐二醇、槐米甲素、槐米乙素、槐米丙素和黏液质等。